以下关于病毒分离的组织培养相关描述中，正确的是
A. 包括器官培养、移植培养和细胞培养
B. 细胞培养最常用于培养病毒
C. 是将离体活组织块或分散的活细胞加以培养的一种方法
D. 移植培养属于组织培养法的一种类型
E. 以上均正确

正确答案：E。以上均正确

解析：病毒分离培养方法—组织培养：将离体活组织块或分散的活细胞加以培养，统称为组织培养。组织培养法有三种基本类型，即器官培养、移植培养和细胞培养。细胞培养最常用于培养病毒。掌握“病毒感染检查方法及防治原则”知识点。